人乳头瘤病毒的传播方式是经
A. 呼吸道传播
B. 虫媒传播
C. 性接触传播
D. 消化道传播
E. 血液传播

正确答案：C。性接触传播

解析：人乳头瘤病毒主要引起人类皮肤黏膜的增生性病变，人乳头瘤病毒的传播主要通过直接接触感染者的病变部位或间接接触被病毒污染的物品，生殖道感染与性行为有关，可通过性接触传播（C对）。呼吸道传播（A错）是流感病毒、鼻病毒、腺病毒等的传播方式；虫媒传播（B错）是出血热病毒、脑炎病毒等的传播方式；消化道传播（D错）是脊髓灰质炎病毒、轮状病毒、新型肠道病毒等的传播方式；血液传播（E错）是乙型肝炎病毒、丙型肝炎病毒、巨细胞病毒等的传播方式（P221表23-1）。